片剂的润滑剂
A. 聚乙烯吡咯烷酮溶液
B. L-羟丙基纤维素
C. 乳糖
D. 乙醇
E. 聚乙二醇6000

正确答案：E。聚乙二醇6000

解析：本题考查片剂的常用辅料。广义的润滑剂按作用不同可以分为三类：助流剂、抗黏剂和狭义润滑剂。常用的润滑剂（广义）有硬脂酸镁（MS）、微粉硅胶、滑石粉、氢化植物油、聚乙二醇类（PEG4000、PEG6000）（E对）、十二烷基硫酸钠等。聚乙烯吡咯烷酮溶液（A错）常用作片剂的黏合剂。低取代羟丙基纤维素（L-HPC）（B错）为崩解剂。乳糖（C错）是良好的片剂填充剂。乙醇（D错）为常用润湿剂。